诊断急性心肌梗死特异性最高的心肌坏死标志物是
A. 肌酸磷酸激酶
B. 天门冬氨酸氨基转移酶
C. 肌红蛋白
D. 肌钙蛋白
E. 乳酸脱氢酶

正确答案：D。肌钙蛋白

解析：肌钙蛋白存在于心肌和骨骼肌中，心肌肌钙蛋白是心肌肌肉收缩的调节蛋白，其与骨骼肌中的异质体具有不同的氨基酸顺序，由不同的基因所编码，具有独特的抗原性，诊断特异性高（D对）。肌酸磷酸激酶（A错）存在于骨骼肌、心肌、脑、胃肠平滑肌，是早期诊断心肌梗死的一项敏感指标，但特异性较低，对于心肌再次梗死的判断具有一定价值（P391）。天门冬氨酸氨基转移酶（B错）存在于心肌、骨骼肌、肝脏，可用于诊断心肌梗死，但是特异性低于肌钙蛋白（P363）。肌红蛋白（C错）主要分布于心肌和骨骼肌，可用于诊断心肌梗死，但是特异性低于肌钙蛋白（P395）。乳酸脱氢酶（E错）存在于人体各种组织中，对于疾病的诊断灵敏度高，特异性低（P392）。